根管治疗过程可发生的并发症
A. 器械折断
B. 急性根尖周炎
C. 皮下气肿
D. 侧壁穿孔
E. 以上都是

正确答案：E。以上都是

解析：本题考查牙髓根尖周病的治疗总论。根管治疗并发症：器械分离（A对）、穿孔（D对）、软组织的化学损伤、急性根尖周炎（B对）、其他（器械的误咽误吸、皮下气肿（C对）、残髓炎等），因此选E。